正确描述指深屈肌的是
A. 起自肱骨内上髁
B. 其肌腱不通过腕管
C. 穿过指浅屈肌腱，止于远节指骨底
D. 在其四个止腱的尺侧有4块蚓状肌附着
E. 屈第1—5指远侧和近侧指间关节、掌指关节及桡腕关节

正确答案：C。穿过指浅屈肌腱，止于远节指骨底

解析：指深屈肌起自尺骨上端前面及附近的骨间膜，而非肱骨内上髁（A错），其肌腱通过腕管入手掌，并非不通过腕管（B错），穿过指浅屈肌腱，止于远节指骨底（C对），4块蚓状肌附着在其两个止腱的尺侧和两个止腱的相邻侧，而非四个止腱的尺侧（D错），作用是屈第2～5指远侧、近侧指骨间关节和掌指关节和屈腕关节，而非第1—5指远侧和近侧指间关节、掌指关节及桡腕关节（E错）。